E.血管扩张剂
A. 洋地黄制剂
B. β受体阻滞剂
C. 钙通道阻滞剂
D. 血管紧张素转换酶抑制剂
E. 血管扩张剂

正确答案：A。洋地黄制剂

解析：急性心肌梗死早期即可出现心力衰竭，发生机制主要是坏死心肌间质充血、水肿引起顺应性下降所致，而左心室舒张末期容量尚不增大，此时用洋地黄既可加重心肌缺氧，也可导致心律失常，因此急性心肌梗死发病24小时内应避免使用的药物是洋地黄制剂（A错，为本题正确答案）。